如果根据慢性毒性试验结果考虑允许某种受试物用于食品，则其未观察到有害作用剂量应
A. 小于或等于人的可能摄入量的10倍
B. 小于或等于人的可能摄入量的50倍
C. 小于人的可能摄入量的100倍
D. 大于或等于人的可能摄入量的100倍
E. 在人的可能摄入量的50倍到100倍之间

正确答案：D。大于或等于人的可能摄入量的100倍

解析：本题考查慢性毒性试验的相关内容。如果根据慢性毒性试验结果考虑允许某种受试物用于食品，则其未观察到有害作用剂量应大于或等于人的可能摄入量的100倍（D对ABCE错）。